与磺胺甲噁唑合用能使后者作用增强
A. 磺胺嘧啶
B. 头孢氨苄
C. 甲氧苄啶
D. 青霉素钠
E. 氯霉素

正确答案：C。甲氧苄啶

解析：本题考查抗菌增效剂甲氧苄啶。甲氧苄啶（C对）能阻断二氢叶酸还原成四氢叶酸，与磺胺类药物合用，可产生协同的抗菌作用。磺胺嘧啶（A错）是二氢叶酸合成酶抑制剂。头孢氨苄（B错）为β-内酰胺类抗生素。青霉素钠（D错）是天然的抗菌药。氯霉素（E错）是酰胺醇类抗生素。